竞争性抑制剂与酶结合的部位
A. 活性中心为必须基团
B. 活性中心底物结合基团
C. 调节亚基
D. 结构基因
E. 活性中心催化基团

正确答案：B。活性中心底物结合基团

解析：不可逆性抑制剂共价结合酶活性中心必需基团（A错）。竞争性抑制剂结合酶活性中心底物结合基团（B对）。非竞争性抑制剂结合酶活性中心之外的调节亚基（C错）。反竞争性抑制剂结合酶-底物复合物。竞争性抑制剂与酶的结合不涉及基因水平，因此结构基因（D错）不正确。酶活性中心的催化基团（E错）主要是调节酶的催化功能。